预防性卫生监督与建设项目同步进行，即在哪三个阶段，进行公共场所预防性卫生监督
A. 投资、开工、竣工验收
B. 设计、开工、竣工验收
C. 设计、施工、竣工验收
D. 规划、设计、开工
E. 规划、设计、施工

正确答案：C。设计、施工、竣工验收

解析：本题考查公共场所预防性卫生监督。公共场所预防性卫生监督是指卫生行政部门对新建、改建和扩建公共场所的选址、设计和竣工验收实施的预防性卫生监督活动。预防性卫生监督与建设项目同步进行，即在设计、施工、竣工验收三个阶段（C对ABDE错），进行公共场所预防性卫生监督。